患者，男性。45岁，近日感冒后，上唇及口周皮肤出现多个成簇的针头大小水疱，随后破裂，形成糜烂、结痂，患者自述病变部位灼痒疼痛。下列诊断正确的是
A. 天疱疮
B. 带状疱疹
C. 唇疱疹
D. 药物过敏性口炎
E. 复发性阿弗他溃疡

正确答案：C。唇疱疹

解析：原发性疱疹感染愈合以后，不管其病损的程度如何，有30%～50%的病例可能发生复发性损害。一般复发感染的部位在口唇或接近口唇处，故又称复发性唇疱疹。复发的口唇损害有两个特征：①损害总是以起疱开始，常为多个成簇的疱，单个的疱较少见。②损害复发时，总是在原先发作过的位置，或邻近原先发作过的位置。诱使复发的刺激因素较多，包括阳光、局部机械损伤，特别是轻度发热，如感冒等。在许多病例中情绪因素也能促使复发。复发的前驱阶段，患者可感到轻微的疲乏与不适，病损区有刺激、灼痛、痒、张力增加等症状。大约在10多小时，出现水疱，周围有轻度的红斑。一般情况下，疱可持续到24时以内，随后破裂，接着是糜烂、结痂。从开始到愈合约10天，但继发感染常延缓愈合的过程，并使病损处出现小脓疱，愈合后不留瘢痕，但可有色素沉着。掌握“口腔单纯疱疹”知识点。